易透过血脑屏障的药物具有特点为
A. 与血浆蛋白结合率高
B. 分子量大
C. 极性大
D. 脂溶性高
E. 脂溶性低

正确答案：D。脂溶性高

解析：脑组织内的毛细血管内皮细胞紧密相连，内皮细胞之间无间隙，且毛细血管外表面几乎均为星形胶质细胞包围，这种特殊结构形成了血浆与脑脊液之间的屏障。此屏障能阻碍许多大分子、水溶性或解离型药物通过，只有脂溶性高的药物才能以简单扩散的方式通过血脑屏障。掌握“药物的吸收和分布”知识点。